少阳表里同病腹痛的表现是
A. 腹泻或便秘
B. 痛在少腹，常牵引睾丸疼痛
C. 腹痛牵引前阴，小便淋沥，尿道灼痛
D. 痛连腰背，伴恶寒发热，恶心呕吐
E. 伴嘈杂吐涎，时作时止

正确答案：D。痛连腰背，伴恶寒发热，恶心呕吐

解析：太阳病不解，传入少阳者，胁下硬满，干呕不能食，往来寒热，尚未吐下，脉沉紧者，与小柴胡汤。伤寒四五日，身热恶风，头项强，胁下满，手足温而渴者，小柴胡汤主之。故痛连腰背，伴恶寒发热，恶心呕吐为少阳腹痛（D对）。腹泻或便秘当属阳明（A错）。痛在少腹，常牵引睾丸疼痛（B错）为小肠病当属太阳。腹痛牵引前阴，小便淋沥，尿道灼痛（C错）为石淋，为膀胱病。伴嘈杂吐涎，时作时止（E错）当属阳明。